蛋白激酶A通路中cAMP作用于
A. 蛋白酶
B. 蛋白激酶A
C. 磷蛋白磷酸酶
D. 还原酶
E. 转肽酶

正确答案：B。蛋白激酶A

解析：蛋白激酶A通路以改变靶细胞内cAMP浓度改变和激活cAMP和蛋白激酶A活性为主要特征，当胰高血糖素作用于其受体后，活化的受体可催化激动型G蛋白（Gs）的GDP与GTP交换，导致Gs的α亚基与βγ亚基解离，释放出αs-GTP，后者激活腺苷酸环化酶，催化ATP转化为cAMP。cAMP作用于cAMP依赖性蛋白激酶，即蛋白激酶A（PKA）。掌握“各信号分子及转导机制”知识点。